冬虫夏草主产于
A. 四川
B. 黑龙江
C. 青海
D. 西藏
E. 江苏

正确答案：A、C、D。四川；青海；西藏

解析：本题考查的是冬虫夏草的产地。冬虫夏草主产于四川（A对）、青海（C对）与西藏（D对）。冬虫夏草：【产地】主产于四川、西藏、青海等省区，甘肃、云南、贵州等省亦产。主产于黑龙江（B错）的药材有绵马贯众、升麻、人参、龙胆、五味子、鹿茸等。主产于江苏（E错）的药材有虎杖、太子参、威灵仙、木通、侧柏叶、紫苏叶、洋金花、地肤子、紫花地丁、荆芥、薄荷、土鳖虫、僵蚕等。